在包衣液的处方中，可作为增塑剂的是
A. 二氧化钛
B. CAP
C. 丙二醇
D. 司盘80
E. 吐温80

正确答案：C。丙二醇